关于脑囊虫病的治疗，下列各项中不正确的是
A. 必须住院治疗
B. 病情重，阿苯达唑剂量应加大
C. 病情重，阿苯达唑剂量应减小
D. 在病原治疗的同时或事先降颅压
E. 有囊虫致脑室孔堵塞者，应手术治疗

正确答案：B。病情重，阿苯达唑剂量应加大